按公式计算，正常5岁小儿的收缩压是
A. 84mmHg
B. 88mmHg
C. 90mmHg
D. 92mmHg
E. 100mmHg

正确答案：C。90mmHg

解析：儿童时期正常血压推算公式：收缩压（mmHg）=80+2×年龄（岁）；舒张压（mmHg）=收缩压×2/3，小儿5岁代入上述公式计算收缩压（mmHg）=80+2×5=90mmHg（C对）。